通常属股动脉分支的有
A. 旋股外侧动脉
B. 腹壁下动脉
C. 旋股内侧动脉
D. 股深动脉
E. 穿动脉

正确答案：D。股深动脉

解析：股深动脉（D对）通常属股动脉分支，股动脉的主要分支为股深动脉。